显微鉴别可见菌丝紧密交织，菌丝间可见草酸钙方晶的药材是
A. 灵芝
B. 冬虫夏草
C. 松萝
D. 茯苓
E. 猪苓

正确答案：E。猪苓

解析：本题考查猪苓的显微鉴别。显微鉴别可见菌丝紧密交织，菌丝间可见草酸钙方晶的药材是猪苓（E对）。猪苓【显微鉴别】粉末：菌丝黏结成团（菌丝团），大多无色。散在的菌丝细长、弯曲，直径2～10㎛，有的可见横隔，有分枝或呈结节状膨大。草酸钙结晶呈正八面体形、规则的双锥八面体形或不规则多面体，直径3～60㎛，长至68㎛。灵芝（A错）【显微鉴别】粉末：浅棕色、棕褐色至紫褐色。菌丝散在或黏结成团，无色或淡棕色，细长，稍弯曲，有分枝，直径2.5～6.5㎛。孢子褐色，卵形，顶端平截，外壁无色，内壁有疣状突起，长8～12㎛，宽5～8㎛。冬虫夏草（B错）【显微鉴别】子座头部横切面：①子座周围1列子囊壳，子囊壳卵形至椭圆形，下半部埋于凹陷的子座内。②子囊壳内有多数线形子囊，每个子囊内又有2～8个线形的子囊孢子。③子座中央充满菌丝，其间有裂隙。④具不育顶端（子座先端无子囊壳部分）。松萝（C错）【性状鉴别】松萝地衣体长10～40cm，呈二叉状分枝，基部直径0.8～1.5mm。表面灰绿色或黄绿色，粗枝表面有明显的环状裂纹。质柔韧，略有弹性，不易折断，断面可见中央有线状强韧的中轴。气微，味酸。茯苓（D错）【显微鉴别】粉末：灰白色。①用水或稀甘油装片，可见无色不规则颗粒状团块或末端钝圆的分枝状团块；用水合氯醛液或5%氢氧化钾液装片，则团块溶化露出菌丝。②菌丝细长，稍弯曲，有分枝，无色或带棕色（外层菌丝），直径3～8㎛，稀至16㎛，横壁偶可察见。